酸枣仁汤中养肝血、安心神的药物是
A. 知母
B. 川芎
C. 茯苓
D. 甘草
E. 酸枣仁

正确答案：E。酸枣仁

解析：酸枣仁功效为养血安神，清热除烦，方中酸枣仁有养心安神，宜阴敛汗的作用，本方入心肝二经，补肝血，安心神（E对）。茯苓（C错）宁心安神，知母（A错）滋阴润燥，清热除烦，川芎（B错）调肝血，疏肝气，诸药合方共奏养血安神，清热除烦之用。